患儿，男性，3个月。体重6kg。生命体征平稳，心肺未见异常，血尿常规检查未见异常。其左侧上唇连同鼻底裂开，右侧上唇部分裂开，鼻底尚完整。术前准备项目中错误的是
A. 术前4小时进食牛奶以补充体液
B. 术前3天进行汤匙喂养训练
C. 术前1天清洁局部皮肤
D. 术前30分钟按体重给予阿托品
E. 手术时间较晚的，可以补液支持

正确答案：A。术前4小时进食牛奶以补充体液

解析：本题考查唇腭裂的序列治疗。只有婴幼儿可以在术前4小时口服少量10%葡萄糖液或食糖水，不可进食牛奶（A错，为本题正确答案）。